某男，50岁。冠心病心绞痛病史5年，查血清肌酐、尿素氮均增高。近因劳累复发，心前区疼痛加重1周，神疲乏力，气短懒言，心悸自汗；舌体胖大有齿痕，舌质淡暗，舌苔薄白，脉弱而涩。1周后，患者诉上述症状有所好转，但最近因家庭琐事劳心过度，出现入睡困难，多梦易醒，心悸健忘，纳差。应避免使用的中成药是
A. 柏子养心丸
B. 北芪五加片
C. 人参归脾丸
D. 眠安宁口服液
E. 脑力静糖浆

正确答案：A。柏子养心丸

解析：本题考查的是心悸的辨证论治。最近因家庭琐事劳心过度，出现入睡困难，多梦易醒，心悸健忘，纳差。应避免使用的中成药是柏子养心丸（A错，为本题正确答案）。不寐心脾两虚证：【症状】不易入睡，多梦易醒，心悸健忘，神疲食少，伴头晕目眩，四肢倦怠，腹胀便溏，面色少华。舌淡苔薄，脉细无力。【中成药应用】常用中成药有北芪五加片（B对）、眠安宁口服液（D对）、脑力静糖浆（E对）。人参归脾丸（C对）为心悸心脾两虚证的中成药应用。心悸心脾两虚证：【症状】心悸气短，头晕目眩，失眠健忘，面色无华，倦怠乏力，纳呆食少。舌淡红，脉细弱。【中成药应用】常用中成药有人参归脾丸（大蜜丸）、复方扶芳藤合剂、益气养血口服液、消疲灵颗粒。柏子养心丸为不寐心胆气虚证的中成药应用。不寐心胆气虚证：【症状】虚烦不眠，触事易惊，终日惕惕，胆怯心悸，伴气短自汗，倦怠乏力。舌淡，脉弦细。【治法】益气镇惊，安神定志。【中成药应用】常用中成药有柏子养心丸（水蜜丸）。